细胞内脂肪酸合成的部位是
A. 线粒体
B. 细胞胞液
C. 细胞核
D. 高尔基体
E. 内质网

正确答案：B。细胞胞液

解析：线粒体（A错）中的乙酰CoA经柠檬酸-丙酮酸循环进入细胞胞液（B对）合成脂肪酸。细胞核（C错）是DNA及RNA合成的主要部位。高尔基体（D错）的主要功能将内质网（E错）合成的蛋白质进行加工、分类、包装，然后分门别类地送到细胞特定的部位或分泌到细胞外。